对儿童进行急性呼吸道感染检测，测量疾病的频率指标应选用
A. 发病率
B. 罹患率
C. 患病率
D. 期间患病率
E. 时点患病率

正确答案：A。发病率

解析：本题考查发病率的应用。发病率是疾病流行强度的指标，反映疾病对人群健康影响的程度，发病率高对人群健康危害大。对儿童进行急性呼吸道感染检测，是为了测量疾病流行强度，反应呼吸道疾病对人群健康的危害，测量疾病时应选用发病率（A对BCDE错）最为合理。